边缘性龈炎的最主要治疗原则是
A. 调整咬合
B. 药物治疗
C. 去除病因
D. 手术治疗
E. 调整激素水平

正确答案：C。去除病因

解析：去除病因：通过洁治术彻底清除菌斑、牙石，消除造成菌斑滞留和局部刺激牙龈的因素。对于牙龈炎症较重的患者，可配合局部药物治疗，常用的局部药物有1%过氧化氢、0.12%～0.2%氯已定溶液以及碘制剂。对于不伴有全身疾病的慢性龈炎患者，不应全身使用抗菌药物。掌握“慢性龈炎”知识点。